患者行注射治疗后，出现臀部结块坚硬，漫肿不红，病情进展缓慢，无全身症状，舌苔白腻，脉缓，其诊断是
A. 臀痈
B. 肉瘤
C. 流痰
D. 内陷
E. 无头疽

正确答案：A。臀痈

解析：臀痈是发生于臀部肌肉丰厚处范围较大的急性化脓性疾病，由于肌肉注射引起者俗称针毒结块。相当于西医的臀部蜂窝组织炎。该患者为注射治疗后，出现了臀部结块坚硬，漫肿不红，此为臀痈，亦为针毒结块（A对）。肉瘤是发于皮里膜外，由脂肪组织过度增生而形成的良性肿瘤（B错）。流痰是一种发于骨与关节间的慢性化脓性疾病。因其可随痰流窜于病变附近或较远的组织间隙，壅阻而形成脓肿，破损后脓液稀薄如痰，故名流痰（C错）。内陷为疮疡阳证疾患过程中，因正气内虚，火毒炽盛，导致毒邪走散，正不胜邪，毒不外泄 反陷入里，客于营血，内传脏腑的一种危急疾病（D错）。无头疽是发生于骨与关节间的急性化脓性疾病的统称，因其初起无头故名（E错）。